肱三头肌
A. 长头起于盂上结节
B. 内侧头起于喙突
C. 外侧头起于桡神经沟的外上方
D. 止于桡骨粗隆
E. 可使臂后伸和旋内

正确答案：C。外侧头起于桡神经沟的外上方

解析：肱三头肌长头起于肩胛盂下结节，而非盂上结节（A错）；内侧头起于肱骨后面桡神经沟内下方的骨面，而非喙突（B错）；外侧头起于桡神经沟的外上方（C对）；止于尺骨鹰嘴，而非桡骨粗隆（D错）；可伸肘关节，使肩关节后伸和内收，而非使臂后伸和旋内（E错）。